以下关于重型阿弗他溃疡临床表现描述不正确的是
A. 溃疡边缘整齐，似弹坑状
B. 溃疡边缘不整齐，呈鼠噬状，底部有肉芽组织
C. 溃疡形状规则，红肿隆起
D. 溃疡直径可达10～30mm
E. 溃疡深及黏膜下层直至肌层

正确答案：B。溃疡边缘不整齐，呈鼠噬状，底部有肉芽组织

解析：本题考查重型阿弗他溃疡的临床表现。以下关于重型阿弗他溃疡临床表现描述不正确的是溃疡边缘不整齐，呈鼠噬状，底部有肉芽组织（B错，为本题正确答案）。溃疡边缘不整齐，呈鼠噬状，底部有肉芽组织属于结核性溃疡的临床表现。重型复发性阿弗他溃疡好发于青春期，溃疡边缘整齐，似弹坑状（A对），形状规则，周围组织红肿隆起（C对），基底微硬，表面有灰黄色假膜或灰白色坏死组织。溃疡大而深，直径可达10～30mm（D对），可深及黏膜下层直至肌层（E对）。溃疡期持续时间较长，疼痛剧烈，可造成组织缺损，影响言语及吞咽，常伴全身不适症状和局部淋巴结肿痛。